属于二萜类的化合物是
A. 原白头翁素
B. 桂皮醛
C. 青蒿素
D. 新穿心莲内酯
E. α-细辛醚

正确答案：D。新穿心莲内酯

解析：本题考查的是穿心莲的主要化学成分。属于二萜类的化合物是新穿心莲内酯（D对）。穿心莲叶中含有多种二萜内酯及二萜内酯苷类成分，如穿心莲内酯、新穿心莲内酯、14-去氧穿心莲内酯、脱水穿心莲内酯等。其中穿心莲内酯含量最高，为其主要活性成分。《中国药典》以穿心莲内酯、新穿心莲内酯、14-去氧穿心莲内酯、脱水穿心莲内酯为指标成分进行含量测定，要求其总量不得少于1.5%。原白头翁素（A错）为毛茛苷水解后的产物。桂皮醛（B错）为小分子的苯丙素类衍生物。青蒿素（C错）为倍半萜类化合物。α-细辛醚（E错），2022年考试指南未明确说明。